乳牙根管充填材料常选用
A. 氢氧化钙制剂
B. 氧化锌丁香油糊剂+牙胶尖
C. 氢氧化钙制剂+牙胶尖
D. 氢氧化钙制剂+银尖
E. 氧化锌丁香油糊剂+银尖

正确答案：A。氢氧化钙制剂

解析：本题考查乳牙的根管充填材料。乳牙根管充填材料常选用氢氧化钙制剂（A对）。在乳牙的替换中，由于乳牙根的生理吸收，继承恒牙方可萌出正常位置上，因此乳牙的根管充填材料仅可采用可吸收的不影响乳恒牙交替的糊剂充填，氢氧化钙制剂可以被吸收，不影响恒牙萌出。牙胶尖（BC错）和银尖（DE错）不可吸收，会影响乳牙的吸收和恒牙的萌出，不能用于乳牙的根管充填。